6个月的小儿应完成哪些计划免疫
A. 卡介苗、乙肝疫苗、脊髓灰质炎三价混合疫苗
B. 脊髓灰质炎三价混合疫苗、百白破混合制剂、麻疹疫苗
C. 卡介苗、乙肝疫苗、脊髓灰质炎三价混合疫苗、百白破混合制剂
D. 乙肝疫苗、脊髓灰质炎三价混合疫苗、百白破混合制剂
E. 卡介苗、脊髓灰质炎三价混合疫苗、百白破混合制剂

正确答案：C。卡介苗、乙肝疫苗、脊髓灰质炎三价混合疫苗、百白破混合制剂

解析：婴儿出生后需要接种的疫苗总结如下：1.卡介苗：出生时。2.乙肝疫苗：出生时，出生1个月、6个月。3.脊髓灰质炎疫苗：出生2、3、4个月，复种4岁。4.百白破混合制剂：出生3、4、5个月，复种1.5-2岁、6岁。5.麻疹疫苗：出生8个月，复种6岁。由此可见6个月时已经完成了卡介苗、乙肝疫苗、脊髓灰质炎疫苗、百白破混合制剂的计划免疫（C对）。